液体培养基的主要用途是
A. 分离单个菌落
B. 鉴别菌种
C. 观察细菌运动能力
D. 增菌
E. 检测细菌毒素

正确答案：D。增菌